羟甲戊二酰辅酶A还原抑制剂（他汀类）所致药源性损伤
A. 胃肠系统
B. 肝
C. 肾
D. 肺
E. 神经系统

正确答案：B。肝

解析：本题考查他汀类药物。羟甲戊二酰辅酶A还原抑制剂（他汀类）所致药源性损伤的是肝（B对）。他汀类药物的主要代谢场所是肝脏，其肝脏损害主要导致谷丙转氨酶（ALT）和谷草转氨酶（AST）升高，ALT或AST超过正常值3倍的发生率为0.5%～2%。